辅酶在酶促反应中的作用是
A. 起运载体的作用
B. 维持酶的空间构象
C. 参加活性中心的组成
D. 促进中间复合物形成
E. 提供必需基团

正确答案：A。起运载体的作用